男，35岁。28小时前饱餐后参加剧烈运动时突发腹痛、腹胀。持续性，伴阵发性绞痛，并有频繁呕吐，无肛门排气。病情急剧加重并昏倒。查体：T35.6℃，P126次/分，BP80/50mmHg，急性病容，四肢发绀，全身冷汗。全腹肌紧张，有压痛和反跳痛，肠鸣音消失。腹穿抽出血性液体。该患者所患疾病最主要的病理生理改变是
A. 细胞外液容量迅速减少
B. 心输出量低，外周阻力高
C. 左心室功能不全
D. 短时大量出血
E. 下腔静脉回流障碍

正确答案：A。细胞外液容量迅速减少

解析：青年男性患者，饱餐后剧烈运动（诱因）时突发腹痛、腹胀，频繁呕吐，无肛门排气（提示肠梗阻），全腹肌紧张，有压痛和反跳痛（腹膜刺激征），肠鸣音消失，腹穿抽出血性液体（提示肠梗阻发生绞窄），四肢发绀，全身冷汗，BP80/50mmHg（收缩压＜90mmHg、脉压＜20mmHg提示休克），结合患者病史、体查和腹腔穿刺检查，应诊断为小肠扭转；急性绞窄性肠梗阻。肠梗阻时，肠腔内因气体和液体积聚而膨胀，压力不断升高，使肠壁充血水肿、毛细血管通透性增加，液体外渗，同时胃肠道分泌的液体不能被吸收返回全身血液循环而积存在肠腔，导致体液（主要是细胞外液）大量丢失在第三间隙。此外，呕吐可丢失大量消化液，使细胞外液进一步减少。细胞外液大量减少可引起水、电解质紊乱、酸碱失衡及休克等。因此，该患者所患疾病最主要的病理生理改变是细胞外液容量迅速减少（A对）。腹压增加和血容量不足可使下腔静脉回流减少（E错），心输出量减低（B错）、左心室功能不全（C错），外周血管收缩，外周阻力增加，但不是最主要的病理生理改变。短时大量出血（D错）可见于晚期绞窄性肠梗阻患者。